良性黏膜类天疱疮也称为
A. 大疱型类天疱疮
B. 红斑型类天疱疮
C. 增殖型类天疱疮
D. 瘢痕型类天疱疮
E. 落叶型类天疱疮

正确答案：D。瘢痕型类天疱疮

解析：本题考查黏膜类天疱疮。良性黏膜类天疱疮也称为瘢痕型类天疱疮（D对）。类天疱疮分为大疱性类天疱疮（A错）和瘢痕性类天疱疮。瘢痕性类天疱疮又称良性黏膜类天疱疮，是类天疱疮中较常见的一型，以水疱为主要表现，好发于口腔黏膜，眼结膜等体窍黏膜，又称黏膜类天疱疮。天疱疮分为寻常型天疱疮，增殖型天疱疮（C错），落叶型天疱疮（E错）和红斑型天疱疮（B错）。类天疱疮没有这些分型。